脊髓第8颈节平对
A. 第4颈椎
B. 第5颈椎
C. 第7颈椎
D. 第8颈椎
E. 第6颈椎

正确答案：C。第7颈椎

解析：根据脊髓节段与椎骨的对应关系，脊髓第8颈节平对第7颈椎（C对）。